欲对全县中小学生的钩虫病进行治疗，首先进行何种流行病学调查方法
A. 抽样调查
B. 病例对照调查
C. 病群研究
D. 普查
E. 血清流行病学调查

正确答案：D。普查

解析：本题考查普查的目的。普查（D对ABCE错）的目的主要包括：①早期发现、早期诊断和早期治疗病人；②了解慢性病的患病及急性传染性疾病的疫情分布；③了解当地居民健康水平；④了解人体各类生理生化指标的正常值范围。题干中的研究目的适用于普查。